对N-亚硝基化合物致癌作用有抵抗力的动物是
A. 豚鼠
B. 猫
C. 黑舌狗
D. 猴
E. 尚未发现

正确答案：E。尚未发现